痛经之所以随月经周期而发作，与下列哪项有关
A. 寒凝胞中
B. 经期胞中血虚邪盛
C. 经期冲任气血变化急骤
D. 冲任血虚、胞宫失养
E. 湿热蕴结胞中

正确答案：C。经期冲任气血变化急骤

解析：痛经的主要病机在于邪气内伏或精血素虚，更值经行前后冲任气血变化急骤，导致冲任气血运行不畅，胞宫经血运行受阻，或冲任胞宫失于濡养（C对）。